下列哪一项不是水平传播
A. 空气传播
B. 母婴传播
C. 食物传播
D. 疫水传播

正确答案：B。母婴传播

解析：本题考查水平传播。水平传播是指病原体在外环境中借助传播因素实现人与人之间的传播。空气传播（A对）、食物传播（C对）、疫水传播（D对）都属于水平传播。母婴传播（B错，为本题正确答案）也称垂直传播，是指病原体通过母体直接传给子代。